躯体运动神经释放的是
A. 去甲肾上腺素
B. 肾上腺素
C. 乙酰胆碱
D. 多巴胺
E. GABA

正确答案：C。乙酰胆碱